调（牙合）的过程中，不必进行的是
A. 让患者先学会做正确的咬合
B. 兼顾正中（牙合）和非正中（牙合）的调整
C. 分次完成
D. 牙周袋内上药
E. 脱敏、抛光

正确答案：D。牙周袋内上药

解析：本题考查选磨的原则及方法。牙周病患者出现深牙周袋时可进行牙周袋内上药（D错，为本题的正确答案），起消炎止痛灭菌促进愈合，一般在调（牙合）之前完成。调（牙合）时，首先要让患者先学会做正确的咬合（A对），准确定出早接触或（牙合）干扰点后再进行调磨。调磨过程中应兼顾正中（牙合）和非正中（牙合）的调整（B对）。一次不应磨牙太多，应分次完成（C对）以免患者肌肉疲劳，妨碍对早接触或（牙合）干扰点的准确定位。调（牙合）过程中对敏感部位可进行脱敏（E对）治疗，以减轻患者的不适。调（牙合）完成后，应对牙面进行抛光（E对），减少牙菌斑的聚集。